使亚铁血红蛋白转化为高铁血红蛋白，造成机体组织缺氧的食物中毒是
A. 组胺中毒
B. 河豚鱼中毒
C. 毒蕈中毒
D. 瘦肉精中毒
E. 亚硝酸盐中毒

正确答案：E。亚硝酸盐中毒

解析：亚硝酸盐为强氧化剂，可使机体血液中正常携氧的亚铁血红蛋白转化为高铁血红蛋白，造成机体组织缺氧（E对）。组胺中毒是一种过敏性食物中毒，与个人体质有关，大量组胺进入机体后可引起毛细血管扩张和支气管收缩而导致中毒（A错）。河豚鱼所含毒素为河豚毒素，河豚毒素为神经毒素，进入机体后主要使神经中枢和神经末梢发生麻搏（B错）。毒蘑菇中毒的毒性成分复杂，各种毒蘑菇中毒机制各异，主要的毒素有胃肠毒素，神经、精神毒素，溶血毒素，肝肾毒素，类光过敏毒素（C错）。瘦肉精为肾上腺素受体激动剂类药物，可引起心脏兴奋及支气管平滑肌持久的扩张而导致中毒（D错）。